水肿是指
A. 细胞内液过多
B. 细胞外液过多
C. 组织间隙或体腔内液体过多
D. 血管内液体过多
E. 体内液体过多

正确答案：C。组织间隙或体腔内液体过多

解析：水肿是指组织间隙或体腔内液体过多（C对），如水肿发生于体腔内，则称之为积水。